麦冬的功效是
A. 益气
B. 清心
C. 潜阳
D. 明目
E. 敛汗

正确答案：B。清心

解析：本题考查的是麦冬的功效。麦冬的功效是清心（B对）。麦冬：【功效】润肺养阴，益胃生津，清心除烦，润肠通便。黄精：【功效】滋阴润肺，补脾益气（A错）。龟甲：【功效】滋阴潜阳（C错），益肾健骨，养血补心，凉血止血。枸杞子：【功效】滋补肝肾，明目（D错），润肺。酸枣仁：【功效】养心安神，敛汗（E错）。